下列各项，不属于感染性发热疾病的是
A. 疟疾
B. 猩红热
C. 病毒性肝炎
D. 广泛性皮炎
E. 伤寒

正确答案：D。广泛性皮炎

解析：感染性发热，是由各种病原体（病毒、细菌、支原体、衣原体、立克次体、螺旋杆菌、真菌、寄生虫等）（ABCE对）侵入机体所引起的感染，不论是急性还是慢性、局限性或全身性，均可出现发热。其发病机制是由于病原微生物的代谢产物或其毒素作用于白细胞而产生并释放内源性致热源，其分子质量小，可通过血-脑屏障直接作用于体温调节中枢，使体温调定点上移，从而引起发热。免疫性疾病、红斑狼疮、风湿热、类风湿性关节炎、结节性动脉周围炎、广泛性皮炎（D错，为本题正确答案）可引起非感染性发热。